相当于121℃热压灭菌时杀死容器中全部微生物所需要的时间，目前仅用于热压灭菌
A. F值
B. HLB值
C. Krafft点
D. 昙点
E. F₀值

正确答案：E。F₀值